衡量一个国家医疗卫生水平的重要指标是
A. 胎儿期死亡率
B. 围生期死亡率
C. 新生儿期死亡率
D. 婴儿期死亡率
E. 幼儿期死亡率

正确答案：B。围生期死亡率

解析：围生期死亡率是指从怀孕满28周至出生后7天内这段时间内小儿的死亡率，围生儿很容易受到胎内、分娩过程中及出生后各种因素的影响而患病，甚至死亡，因此，衡量一个国家医疗卫生水平的重要指标是围生期死亡率（B对）。